下述论述哪条正确
A. 乙肝主要经血传播
B. 甲肝主要经性传播
C. 丁肝主要经食物传播
D. 丙肝主要经垂直传播
E. 戊肝主要经生活接触传播

正确答案：A。乙肝主要经血传播

解析：本题考查病毒性肝炎的传播途径。甲肝（B错）和戊肝（E错）主要通过粪-口途径传播。乙肝主要传播途径有经血传播（A对）、母婴传播、性接触传播和日常生活接触传播；丙肝主要传播途径为经血传播和性接触传播，母婴传播概率较低（D错）；丁肝主要经血或血液制品传播（C错）。